对幼龄动物发现关节软骨的损害，不宜用于孕妇、小儿的药物是
A. β-内酰胺类抗生素
B. 氨基糖苷类抗生素
C. 喹诺酮类抗菌药
D. 糖皮质激素类药物
E. 非甾体抗炎药

正确答案：C。喹诺酮类抗菌药

解析：本题考查药物的不良反应。对幼龄动物发现关节软骨的损害，不宜用于孕妇、小儿的药物是喹诺酮类抗菌药（C对）。喹诺酮类抗菌药的作用机制为抑制DNA的合成，在幼鼠中发现该类药物对软骨的损害，故此类药物不宜用于小儿、孕妇，哺乳期应用时需暂停哺乳，因药物可分泌至乳汁中。β-内酰胺类抗生素（A错）的不良反应为过敏反应、腹泻、头晕、疹块、荨麻疹。氨基糖苷类抗生素（B错）的不良反应有耳毒性、肾毒性等。糖皮质激素类药物（D错）的不良反应有皮质功能亢进综合征、诱发或加重感染、诱发或加重溃疡病、骨质疏松、肌肉萎缩、伤口愈合延缓等。非甾体抗炎药（E错）的不良反应主要为胃肠道反应。